靶向人类表皮生长因子受体-2（HER-2）的基因工程抗体被用于治疗
A. 转移性结直肠癌
B. 毛细胞白血病
C. 乳腺癌
D. B细胞淋巴瘤
E. 转移性黑色素瘤

正确答案：C。乳腺癌

解析：靶向人类表皮生长因子受体-2（HER-2）的基因工程抗体被用于治疗乳腺癌。掌握“肿瘤免疫”知识点。